男性，19岁。2日来出现皮肤紫癜，以下肢为主，两侧对称，颜色鲜红，高出皮肤表面，伴有关节痛及腹痛，应诊断为
A. 血小板减少性紫瘢
B. 过敏性紫瘢
C. 急性白血病
D. 急性关节炎
E. 急腹症

正确答案：B。过敏性紫瘢

解析：患者青年男性，2日来出现皮肤紫癜，以下肢为主，两侧对称，颜色鲜红，高出皮肤表面（过敏性紫癜典型的皮肤表现），伴有关节及腹痛（过敏性紫癜可累及关节部位血管引起关节肿痛，累及消化道黏膜引起腹痛），故患者应诊断为过敏性紫癜（B对）。血小板减少性紫瘢（P614）（A错）可有皮肤出血，表现为瘀点、紫癜、瘀斑，但紫癜不成对称性，不伴关节及腹痛；急性白血病（P571）（C错）出血可发生在全身各部位，以皮肤瘀点、瘀斑、鼻出血、牙龈出血多见，不伴关节及腹痛；急性关节炎（D错）主要表现为关节肿痛、功能障碍，不会出现典型的皮肤紫癜表现；急腹症（E错）主要表现为剧烈腹痛，无紫癜及关节痛表现。